硬脑膜窦
A. 内含动脉血
B. 窦壁内有丰富的平滑肌
C. 损伤后平滑肌收缩能自行止血
D. 与颅外静脉无交通
E. 由硬脑膜在某些部位两层分开，内衬内皮细胞构成

正确答案：E。由硬脑膜在某些部位两层分开，内衬内皮细胞构成

解析：硬脑膜窦由硬脑膜在某些部位两层分开，内衬内皮细胞构成（E对）。窦内含静脉血（A错）。窦壁无平滑肌（B错），不能收缩，故损伤出血时难以止血（C错），容易形成颅内血肿。